患者，女性，中年。单侧口角抽搐，精神紧张，疲倦时加重，发作时伴同侧耳鸣、头痛、同侧味觉改变，间歇性发作。睡眠时停止发作。初步诊断面肌痉挛，不需与下列疾病相鉴别的是
A. 继发性面肌痉挛
B. 癔症性眼睑痉挛
C. 三叉神经痛
D. 疱疹病毒感染
E. 舞蹈病及手足徐动症

正确答案：D。疱疹病毒感染

解析：疱疹病毒感染的临床表现主要为持续性剧烈疼痛，睡眠时不会停止发作。往往不伴有耳鸣、头痛、味觉改变等症状，常沿三叉神经分布，并伴有皮肤疱疹等体征。掌握“面神经麻痹”知识点。